患者，女性，31岁，产后第5天。3小时前突然出现呼吸困难、胸痛、咳嗽、咯血。该患者最可能的诊断是
A. 支气管炎
B. 支气管哮喘
C. 肺血栓栓塞症
D. 急性心肌梗死
E. 肺炎

正确答案：C。肺血栓栓塞症

解析：根据病史及所给出的备选答案，支气管炎显然不符合该患者的临床表现。支气管哮喘虽可出现突发呼吸困难，但一般无胸痛、咳嗷、咯血等且有反复发作特点。急性心肌梗死一般无咳嗽、咯血，且一般有心血管相关病史。肺炎的临床表现可有呼吸困难、胸痛、咳嗽、咯血，但一般以发热、咳漱、咳痰为主，肺炎控制不好，影响氧合可渐出现呼吸困难。该患者为产褥期妇女，结合临床表现C为最可能答案。掌握“肺血栓栓塞症”知识点。